治疗充血性心力衰竭气阴两虚证的首选方剂是
A. 生脉散加减
B. 独参汤
C. 苓桂术甘汤
D. 真武汤
E. 桃红四物汤

正确答案：A。生脉散加减

解析：心力衰竭之气阴两虚，症见心悸气短，身重乏力，心烦不寐，口咽干燥，小便短赤，舌质暗红，少苔或无苔，脉细数或促或结代，用生脉饮合血府逐瘀汤，益气养阴，活血化瘀（A对）。独参汤适于大失血，气随血脱之时（B错）。苓桂术甘汤温阳化饮，健脾利水，适于中阳不足之痰饮（C错）。真武汤温阳利水，适于阳虚水泛证（D错）。桃红四物汤适于血虚版血瘀证（E错）。